为降低肾毒性而制成脂质体剂型的抗真菌药物是
A. 灰黄霉素
B. 氟胞嘧啶
C. 两性霉素B
D. 卡泊芬净
E. 氟康唑

正确答案：C。两性霉素B

解析：本题考查两性霉素B。为降低肾毒性而制成脂质体剂型的抗真菌药物是两性霉素B（C对）。两性霉素B为多烯类广谱抗真菌药，曾为治疗深部真菌感染的标准药物，目前仍为深部真菌感染的主要选用药物之一，然而其明显的肾毒性和输注相关不良反应等缺点限制了其临床应用，两性霉素B含脂制剂的抗菌谱、抗菌活性和临床疗效与两性霉素B去氧胆酸盐相仿，但毒性反应明显降低。灰黄霉素（A错）是非多烯类抗真菌药，用于各种癣病的治疗，包括头癣、须癣、体癣、股癣、足癣和甲癣。氟胞嘧啶（B错）是胞嘧啶类化合物，适用于敏感念珠菌或（和）隐球菌所致严重感染的治疗，如念珠菌所致的败血症、心内膜炎和尿路感染，治疗播散性真菌病时通常与两性霉素B联合应用，因单独应用时易致真菌耐药性的发生。卡泊芬净（D错）是棘白霉素类抗真菌药，抗菌谱较广，抗菌活性较强，与其他抗真菌药之间无交叉耐药。氟康唑（E错）属于三唑类抗菌药，是治疗侵袭性念珠菌病的首选用药，适用于近期未用过唑类抗真菌药且临床情况稳定的念珠菌感染。